关于膝关节说法错误的是
A. 是全身关节中最复杂的关节
B. 有腓侧副韧带加固
C. 有由透明软骨构成的半月板
D. 有交叉韧带
E. 可作屈伸运动

正确答案：C。有由透明软骨构成的半月板

解析：膝关节是人体最大最复杂的关节（A对），内含有纤维软骨构成的半月板（C错，为本题正确答案），关节囊由髌韧带、腓侧副韧带（B对）、胫侧副韧带、腘斜韧带、膝交叉韧带（D对）加固。膝关节是单轴关节,属屈戌关节,主要做屈伸运动（E对），但是在半屈膝位可以做少许旋内和旋外运动。